可直接导致意识障碍的心律失常是
A. 室性期前收缩
B. 房性期前收缩
C. 心室颤动
D. 右束支阻滞
E. 窦性心动过速

正确答案：C。心室颤动

解析：可直接导致意识障碍的心律失常是心室颤动（C对），心室颤动患者可直接导致意识障碍、抽搐、呼吸停顿甚至死亡。室性期前收缩（A错）表现为心悸，类似电梯快速升降的失重感。房性期前收缩（B错）主要表现为心悸、胸闷、乏力症状。右束支阻滞（D错）临床上常无症状。窦性心动过速（E错）主要表现为心悸、气短、胸闷、烦躁等症状。